血药浓度已降阈浓度以下，药物仍残存的药理效应
A. 副作用
B. 毒性反应
C. 后遗效应
D. 停药反应
E. 变态反应

正确答案：C。后遗效应

解析：后遗效应是指药物停用后，血药浓度已降至阈浓度以下时，药物仍残存的药理效应。例如服用巴比妥类催眠药后，次晨出现的乏力、困倦等现象。掌握“药物不良反应”知识点。